在设计配对调查时确定配对条件的主要原则是
A. 对所研究疾病有影响的项目均应列为配对条件
B. 对所研究疾病有较大的直接影响的项目均应列为配对条件
C. 对所研究疾病有较大的直接影响的项目，但又不是本研究项目的应列为配对条件
D. 年龄和性别必须作为配对条件
E. 对所研究疾病有较大影响的项目应全部列为配对条件

正确答案：C。对所研究疾病有较大的直接影响的项目，但又不是本研究项目的应列为配对条件